患者，女，13岁，有哮喘病史，半年前月经初潮，周期28天，经期持续4～5天，月经前两天疼痛明显影响正常的学习和活动，诊断为原发性痛经，适宜该患者使用的缓解痛经的药物是
A. 布洛芬片
B. 塞来昔布胶囊
C. 对乙酰氨基酚片
D. 吲哚美辛栓
E. 尼美舒利片

正确答案：C。对乙酰氨基酚片

解析：本题考查对乙酰氨基酚片。患者出现题干症状适宜使用的缓解痛经药物是对乙酰氨基酚片（C对），对乙酰氨基酚用于缓解轻、中度疼痛；布洛芬片（A错）对阿司匹林或其它非甾体抗炎药过敏者可有交叉过敏反应；塞来昔布（B错）、尼美舒利（E错）均为选择性COX-2抑制剂，可能诱发哮喘，有哮喘病史的患者慎用；吲哚美辛（D错）可使出血时间延长。